产后大出血，继则冷汗淋漓，甚则晕厥。其病机是
A. 气滞血瘀
B. 气不摄血
C. 气随血脱
D. 气血两虚
E. 气血失和

正确答案：C。气随血脱

解析：气随血脱证是指大出血时引起气脱的证候。产后大出血多因气血相互依存，大量出血，气无所附，随之外脱所致；冷汗淋漓多因气脱阳亡，不能温固肌表所致；甚则晕厥多因神随气散，神无所主所致。故其病机为气随血脱（C对）。气滞血瘀以局部胀满、刺痛、拒按、面色晦暗、舌紫或有瘀斑、脉弦涩等为辨证要点，非上述症状（A错）。气不摄血以慢性出血，尤其是便血、肌衄、崩漏及面白气短、神疲乏力、舌淡脉弱等为辨证要点，非上述症状（B错）。气血两虚以面色淡白或萎黄、心悸气短、眩晕乏力等为辨证要点，非上述症状（D错）。气血失和，为人造干扰项（E错）。